丹毒的致病菌是
A. 梭状芽胞杆菌
B. 乙型溶血性链球菌
C. 金黄色葡萄球菌
D. 白色念珠菌
E. 表皮葡萄球菌

正确答案：B。乙型溶血性链球菌